精子储存于
A. 精囊
B. 前列腺
C. 附睾
D. 睾丸
E. 尿道球腺

正确答案：C。附睾

解析：附睾（C对）为精子的储存部位，并为精子提供营养，促进精子进一步成熟。